携带病原体3个月以内者称
A. 传染病患者
B. 病原携带者
C. 慢性病原携带者
D. 受感染的动物
E. 暂时病原携带者

正确答案：E。暂时病原携带者